切割运动中生物力学杠杆作用的叙述中，正确的是
A. 以前牙切咬的食物为重点
B. 前牙所承受的咀嚼力较小
C. 可形成第Ⅲ类杠杆
D. 前牙主要进行切割运动
E. 以上都正确

正确答案：E。以上都正确

解析：切割运动中生物力学杠杆作用：在切割运动中，以前牙切咬的食物为重点，颞下颌关节为支点，升颌肌群以咬肌和颞肌为主要动力点，形成第Ⅲ类杠杆，阻力臂长于动力臂，机械效能较低，但前牙所承受的咀嚼力较小，有利于维护狭小的单根前牙和其牙周组织的健康。掌握“咀嚼过程、类型，咀嚼周期及生物力”知识点。